正常人体内血氨的主要来源是:
A. 血内尿素进入肠腔分解产氨
B. 肾小管上皮细胞产氨
C. 蛋白质食物在肠道分解产氨
D. 人体组织蛋白质分解产氨
E. 肌肉活动产氨

正确答案：C。蛋白质食物在肠道分解产氨

解析：正常人体内血氨的主要来源是蛋白质食物在肠道分解产氨（A对）。